患者心悸，气短1年，劳累后加重。检查：脉搏80次/分，节律不规整，心率约110次/分，心律完全不规则，心音强弱绝对不一致。此患者心律失常的类型是
A. 窦性心律不齐
B. 窦性心动过速
C. 早搏
D. 心房颤动
E. 室上性心动过速

正确答案：D。心房颤动

解析：本例患者查体发现脉搏短绌（脉搏80次/分，心率约110次/分），心律完全不规则，心音强弱绝对不一致，此患者心律失常的类型应先考虑为心房颤动（D对）。窦性心律不齐（A错）是指窦性心律的起源未变，但节律不整，心律不齐可与呼吸的周期有关，吸气时加快，呼气时减慢，窦性心律不齐无临床意义。窦性心动过速（B错）指成人窦性心律的频率超过100次/分，但是心音规整，心律齐。早搏（C错）可表现为心悸或心跳暂停感，听诊可发现心律不规则，早搏后有较长的代偿间歇，但心音强度不变。室上性心动过速（E错）发作突然起始与终止，持续时间长短不一，症状包括心悸、胸闷、焦虑不安、头晕，听诊心尖区第一心音强度恒定，心律绝对规则。